吴茱萸的功效是
A. 散寒止痛，降逆止呕，助阳止泻
B. 祛风止痛，温肺化饮，助阳止泻
C. 回阳救逆，温肾助阳，降逆止呕
D. 温中止痛，祛风杀虫，降逆止呕
E. 温中降逆，理气和胃，助阳止泻

正确答案：A。散寒止痛，降逆止呕，助阳止泻

解析：吴茱萸的功效是散寒止痛，降逆止呕，助阳止泻（A对）。